下列哪一项属于正常上唇形态的特点
A. 红唇缘明显，两侧对称构成唇弓
B. 上唇下1/3微向前翘
C. 红唇中部稍厚呈珠状，微向前下突起
D. 两侧人中嵴等高
E. 以上说法都正确

正确答案：E。以上说法都正确

解析：正常上唇的形态特点是：红唇缘明显，两侧对称性地构成唇弓；上唇下1/3部微向前翘；红唇中部稍厚呈珠状而向前下突起，上下唇厚度、宽度比例协调；鼻小柱及鼻尖居中，鼻底宽度适中，两侧鼻翼和鼻孔呈拱状，鼻孔大小位置对称。唇裂修复是一种要求极高的手术，手术效果的优劣会直接影响患者的身心健康与生存质量。掌握“腭裂”知识点。